屈髋关节和伸膝关节的肌是
A. 髂腰肌
B. 臀大肌
C. 大收肌
D. 缝匠肌
E. 股四头肌

正确答案：E。股四头肌

解析：髂腰肌（A错）使髋关节前屈和旋外。臀大肌（B错）使髋关节伸和旋外。大收肌（C错）使髋关节内收和旋外。缝匠肌（D错）屈髋、屈膝关节，使已屈的膝关节旋内。股四头肌（E对）屈髋关节和伸膝关节。